疾病的标与本的概念，下列哪项是不确切的
A. 邪气与正气
B. 外感与内伤
C. 症状与病机
D. 原发病与继发病
E. 先病与后病

正确答案：B。外感与内伤

解析：疾病标本是随着疾病发展变化的具体情况所指有所不同，如就邪正而言，正气为本，邪气为标（A对）。就病机与症状而言，病机为本，症状为标（C对）。就疾病先后而言，旧病、原发病为本，新病、继发病为标（D对E对）。就病位而言，脏腑精气病为本，肌表经络病为标。标本不是绝对的，而是相对的，有条件的（B错，即为本题正确答案）。